男，11个月。母乳喂养，近3月来面色渐苍白，间断腹泻，原可站立，现坐不稳，手足常颤抖。体检面色苍黄，略浮肿，表情呆滞。血红蛋白80g/L，红细胞2.0×10¹²/L，白细胞6.0×10⁹/L。该患儿可能的诊断是
A. 大脑发育不全
B. 营养性缺铁性贫血
C. 维生素D缺乏性手足搐搦症
D. 维生素D缺乏性佝偻病
E. 营养性巨幼红细胞性贫血

正确答案：E。营养性巨幼红细胞性贫血

解析：根据患儿的哺乳方式为单纯母乳喂养，未添加辅食，临床表现为面色渐进苍白、苍黄，略浮肿，间断腹泻，出现神经精神症状坐不稳，手足颤抖，表情呆滞，以及实验室检查血红蛋白80g/L（儿童正常值：110-160g/L）、白细胞6.0×10⁹/L（儿童平均正常值8×10⁹/L）可判定为营养性巨幼红细胞性贫血（E对）。营养性缺铁性贫血虽也会出现面色苍白和消化系统症状，但不会出现不规则性震颤等神经精神症状，实验室检查血红蛋白降低比红细胞数减少明显，白细胞、血小板一般无改变（B错）。维生素D缺乏性手足搐搦症可见于较大婴幼儿突发手足痉挛呈弓状，双手呈腕部屈曲状，手指伸直，拇指内收掌心，强直痉挛（C错）。维生素D缺乏性佝偻病会有骨骼畸形改变（D错）。